健脾丸的组成中有
A. 薏苡仁
B. 莱菔子
C. 鸡内金
D. 黄芪
E. 黄连

正确答案：E。黄连

解析：健脾丸组成为白术、木香、黄连、甘草、白芷、人参、神曲、陈皮、砂仁、麦芽、山楂、山药、肉豆蔻（健脾参术苓草陈，肉蔻香连合砂仁，楂肉山药曲麦炒，消补兼施此方寻）（E对）。